治疗流行性腮腺炎热毒蕴结应首选
A. 柴胡葛根汤加减
B. 银翘散
C. 普济消毒饮
D. 甘露消毒丹
E. 五味消毒饮

正确答案：C。普济消毒饮

解析：治疗流行性腮腺炎热毒蕴结应首选普济消毒饮，热毒蕴结证为痄腮重症，临床以高热，烦躁，口渴，腮部漫肿疼痛，坚硬拒按，张口咀嚼困难为特征。治法为清热解毒，软坚散结。选方普济消毒饮加减（C对）。治疗流行性腮腺炎温毒在表应首选柴胡葛根汤加减（A错）。银翘散用于风热感冒，发热头痛，口干咳嗽，咽喉疼痛，小便短赤（B错）。甘露消毒丹主治湿温时疫，邪在气分，湿热并重证（D错）。五味消毒饮主治疔疮初起，发热恶寒，疮形如粟，坚硬根深，状如铁钉，以及痈疡疖肿，红肿热痛，舌红苔黄，脉数（E错）。